苏合香丸与碘化钾片合用会引起
A. 肾衰竭
B. 听神经损害
C. 药源性肠炎
D. 药源性肝病
E. 汞中毒

正确答案：C。药源性肠炎

解析：本题考查的是中西药联用的使用注意。苏合香丸与碘化钾片合用会引起（C对）。苏合香丸含朱砂，含朱砂较多的中成药，如磁朱丸、更衣丸、安宫牛黄丸等与含较多还原性溴离子或碘离子的中成药如消瘿五海丸、内消瘰疬丸等长期同服，在肠内会形成有刺激性的溴化汞或碘化汞，导致药源性肠炎、赤痢样大便。肾衰竭（A错）为含乙醇的中成药与乙酰氨基酚联用的不良反应。含乙醇的中成药如各种药酒等，不可与对乙酰氨基酚同服，因同用后二者的代谢产物对肝脏损害严重，有些患者对此类药极为敏感，从而可引起肝坏死及急性肾衰竭。药源性肝病（D错）为含水合型鞣质而对肝脏有一定毒性药物与对肝脏有一定毒性的西药联用的不良反应。含水合型鞣质而对肝脏有一定毒性的诃子、五倍子、地榆、四季青等，以及含有这些药物的中成药，不能与对肝脏有一定毒性的西药四环素、利福平、氯丙嗪、异烟肼、依托红霉素等联用，因联用后会加重对肝脏的毒性，导致药源性肝病的发生。汞中毒（E错）为朱砂的不良反应。超剂量或长期服用朱砂或含朱砂的中成药，会引起汞中毒。不良反应为听神经损害（B错）的中西药联用，2022年考试指南未明确说明。